水痘最常见的并发症是
A. 肺炎
B. 心肌炎
C. 脑炎
D. 血小板减少
E. 皮肤感染

正确答案：E。皮肤感染

解析：水痘由水痘－带状疱疹病毒感染所致，主要损害部位在皮肤和黏膜，如破损常并发皮肤感染（E对）。若患者免疫力极低，不能清除病毒，则病毒可到达单核－巨噬细胞系统，引起全身播散性水痘，可波及内脏造成局灶性坏死、充血水肿和出血，但此情况较少见，所以肺炎（A错）、心肌炎（B错）、脑炎（C错）、血小板减少（D错）均不是水痘最常见的并发症。